肺胀是多种肺系疾患反复发作，迁延不愈，导致肺气胀满，不得敛降的一种肺系疾病病，临床表现为胸部膨满，憋闷如塞，喘息上气，咳嗽痰多等症状。可参考肺胀辨证论治的疾病是
A. 慢性阻塞性肺疾病
B. 支气管哮喘
C. 获得性肺炎
D. 上呼吸道感染
E. 病毒性肺炎

正确答案：A。慢性阻塞性肺疾病

解析：本题考查的是肺胀。肺胀是多种肺系疾患反复发作，迁延不愈，导致肺气胀满，不得敛降的一种肺系疾病病，临床表现为胸部膨满，憋闷如塞，喘息上气，咳嗽痰多等症状。可参考肺胀辨证论治的疾病是慢性阻塞性肺疾病（A对）。肺胀是多种肺系疾患反复发作，迁延不愈，导致肺气胀满，不得敛降的疾病，临床表现为胸部膨满，憋闷如塞，喘息上气，咳嗽痰多，烦躁，心悸，面色晦暗，或唇甲青紫，脘腹胀满，肢体浮肿等。西医学中慢性阻塞性肺疾病、慢性肺源性心脏病有上述表现者，可参考此内容辨证论治。支气管哮喘（B错）、获得性肺炎（C错）与病毒性肺炎（E错）可参考喘证辨证论治。喘即气喘、喘息。喘证是以呼吸困难，甚至张口抬肩、鼻翼扇动、不能平卧为特征的疾病。西医学的肺炎、支气管炎、肺气肿、肺源性心脏病、心源性哮喘以及癔病等发生呼吸困难时，可参考此内容辨证论治。上呼吸道感染（D错）可参考感冒辨证论治。感冒是感受风邪或时行病毒，卫表失和而导致的常见外感疾病，临床表现以鼻塞、流涕、喷嚏、头痛、恶寒、发热、全身不适、脉浮等为特征。西医学中普通感冒（伤风）、流行性感冒（时行感冒）及其他上呼吸道感染，有上述临床表现者可参考此内容辨证论治。